引起急性肾小球肾炎最常见的病原体为
A. 结核分枝杆菌
B. 金黄色葡萄球菌
C. 柯萨奇病毒
D. 寄生虫
E. 溶血性链球菌

正确答案：E。溶血性链球菌

解析：急性肾小球肾炎是以急性肾炎综合征为主要临床表现的一组疾病。其特点为急性起病，患者出现血尿、蛋白尿、水肿和高血压，并可伴有一过性肾功能不全，常因β-溶血性链球菌（E对）感染所致，其它病原体感染后的急性肾炎可由许多细菌、病毒及寄生虫（D错）感染，目前较常见于多种病毒（如水痘-带状疱疹病毒、EB病毒、流感病毒等）感染，金黄色葡萄球菌（B错）与柯萨奇病毒（C错）少见。结核分枝杆菌（A错）常导致结核病，而不会引起肾小球肾炎。